有研究者欲分析白酒的平均销售量与肝癌的死亡率之间的关系，收集了1998年全国20个大城市白酒的平均销售量与肝癌的死亡率资料。该研究者运用的研究方法是
A. 历史资料分析
B. 随访研究
C. 生态学研究
D. 筛查
E. 现况研究

正确答案：C。生态学研究